水质监测采样点应设置在
A. 水源取水口
B. 出厂水口
C. 居民经常用水点处
D. 出厂水口和管网末梢
E. 水源取水口、出厂水口和居民经常用水点

正确答案：E。水源取水口、出厂水口和居民经常用水点

解析：本题考查水质监测采样点的设置。水质监测采样点的设置应有代表性，应分别设在水源取水口、出厂水口和居民经常用水点处（E对ABCD错）。